注射后药物经门静脉进入肝脏，可能影响药物的生物利用度
A. 静脉注射
B. 皮下注射
C. 皮内注射
D. 鞘内注射
E. 腹腔注射

正确答案：E。腹腔注射